药品的特殊性包括
A. 需要迫切性
B. 消费者低选择性
C. 缺乏需求价格弹性
D. 社会公共性
E. 竞争性

正确答案：A、B、C、D。需要迫切性；消费者低选择性；缺乏需求价格弹性；社会公共性